《素问·诊要经终论》载“戴眼，反折，瘛疭，其色白，绝汗乃出”，见于什么脉的经气血衰竭
A. 太阴脉
B. 少阴脉
C. 阳明脉
D. 少阳脉
E. 太阳脉

正确答案：E。太阳脉

解析：太阳之脉，其终也戴眼，反折，瘛疭，其色白，绝汗乃出，出则死矣（E对）。少阳终者，耳聋，百节皆纵，目圜绝系，绝系一日半死，其死也，色先青白，乃死矣（D错）。阳明终者，口目动作，善惊，妄言，色黄，其上下经盛，不仁，则终矣（C错）。少阴终者，面黑，齿长而垢，腹胀闭，上下不通而终矣（B错）。太阴终者，腹胀闭不得息，善噫，善呕，呕则逆，逆则面赤，不逆则上下不通，不通则面黑，皮毛焦而终矣（A错）。厥阴终者，中热嗌干，善溺心烦，甚则舌卷，卵上缩而终矣。此十二经之所败也。